前牙鸠尾峡的宽度一般为邻面洞舌方宽度的
A. 1/4～1/3
B. 1/5～1/4
C. 1/3～1/2
D. 2/3～3/4
E. 1/3～2/5

正确答案：C。1/3～1/2

解析：本题考查鸠尾固位。鸠尾是一种机械固位结构，外形似斑鸠的尾部，由鸠尾峡和膨大的尾部组成，可借助于峡部的扣锁作用防止充填体从与洞底呈水平方向的脱位。鸠尾峡的宽度一般在后牙为所在颊舌尖间距的1/4～1/3，前牙为邻面洞舌方宽度1／3～1／2（C对）。